亚慢性毒性试验中一般化验指标有
A. 血象、肝、肾功能
B. 病理学检查
C. 灵敏指标的检查
D. 特异指标的检查

正确答案：A。血象、肝、肾功能

解析：本题考查亚慢性毒性试验中一般化验指标。亚慢性毒性试验中一般化验指标有血象、肝、肾功能等（A对BCD错）。